连续规律用药2日以上方能充分发挥作用的药品是
A. 吸入性糖皮质激素
B. 非甾体抗炎药
C. β受体阻断剂
D. 短效β₂受体激动剂
E. 白三烯受体阻断剂

正确答案：A。吸入性糖皮质激素

解析：本题考查糖皮质激素类药物。连续规律用药2日以上方能充分发挥作用的药品是吸入性糖皮质激素（A对）。吸入性糖皮质激素为控制呼吸道炎症的预防性用药，起效缓慢且需连续和规律地应用2日以上方能充分发挥作用。短效β₂受体激动剂（D错）通常在数分钟内起效，适用于迅速缓解轻、中度哮喘急性症状，也可用于运动性哮喘。白三烯受体阻断剂（E错）起效慢，一般连续应用4周显效。